脂质体是一种具有多功能的药物载体，不属于其特点的是
A. 具有靶向性
B. 降低药物毒性
C. 提高药物稳定性
D. 组织相容性差
E. 具有长效性

正确答案：D。组织相容性差

解析：本题考查脂质体。药物被脂质体包封后具有以下特点：（1）靶向性（A对）和淋巴定向性。（2）缓释和长效性（E对）。（3）细胞亲和性与组织相容性（D错。为本题正确答案）：脂质体是具有类似生物膜结构的泡囊，有细胞亲和性与组织相容性，长时间吸附于靶细胞周围，使药物能充分向靶细胞组织渗透，脂质体也可通过融合进入细胞内，经溶酶体消化释放药物。（4）降低药物毒性（B对）。（5）提高药物稳定性（C对）。